叩击心脏或肝脏被肺的边缘所覆盖的部分所产生的叩诊音为
A. 清音
B. 浊音
C. 鼓音
D. 实音
E. 过清音

正确答案：B。浊音

解析：浊音（B对）是一种音调较高，音响较弱，振动持续时间较短的非乐性叩诊音，除音响外，板指所感到的振动也较弱，当叩击被少量含气组织覆盖的实质脏器时产生，如叩击心或肝被肺段边缘所覆盖的部分，或在病理状态下如肺炎（肺组织含气量减少）的叩诊音。清音（A错）是正常肺部的叩诊音。鼓音（C错）如同击鼓声，是一种和谐的乐音，音响比清音更强，振动持续时间也较长。实音（D错）是一种音调较浊音更高，音响更弱，振动持续时间更短的一种非乐性音。过清音（E错）介于鼓音与清音之间，是属于鼓音范畴的一种变音。